男性，30岁。1周来发热伴皮肤出血点。化验血呈全血细胞减少。骨髓检查增生极度活跃，原始细胞占骨髓非红系有核细胞的40％，各阶段粒细胞占50％，各阶段单核细胞占30％，诊断急性白血病，其FAB分类的类型是
A. M1
B. M2
C. M4
D. M5
E. M6

正确答案：C。M4

解析：患者已诊断为急性白血病，需根据骨髓象进行FAB分型，患者骨髓检查增生极度活跃，原始细胞占骨髓非红系有核细胞的40％（原始细胞≥骨髓非红系有核细胞的30%可诊断为急性白血病），各阶段粒细胞占50％（M₄各阶段粒细胞≥20%），各阶段单核细胞占30％（M₄各阶段单核细胞≥20%），故该患者FAB分型为急性粒-单核细胞白血病（M₄）（C对）。M₁（急性粒细胞白血病未分化型）（P569）（A错）原粒细胞≥骨髓非红系有核细胞的90%；M₂（急性粒细胞白血病部分分化型）（P569）（B错）原粒细胞占骨髓非红系有核细胞的30%～89%，其他粒细胞≥10%，单核细胞＜20%；M₅（急性单核细胞白血病）（P569）（D错）骨髓中原单核、幼单核≥骨髓非红系有核细胞的30%，且原单核、幼单核及单核细胞≥80%；M₆（急性红白血病）（P569）（E错）骨髓幼红细胞≥50%，原始细胞≥骨髓非红系有核细胞的30%。